胆固醇体内代谢的主要去路是在肝中转化为
A. 乙酰CoA
B. NADPH
C. 维生素D
D. 粪固醇
E. 胆汁酸

正确答案：E。胆汁酸

解析：胆固醇在肝脏可转化为胆汁酸，这是胆固醇在体内代谢的主要去路。胆汁酸盐随胆汁排入肠道，参与脂类的消化吸收，其中一小部分受肠道细菌作用还原成粪固醇被排出体外。掌握“甘油磷脂、胆固醇和血脂蛋白代谢”知识点。